治疗慢性宫颈炎湿热内蕴证，应首选
A. 龙胆泻肝汤
B. 止带方
C. 二妙丸
D. 五味消毒饮
E. 仙方活命饮

正确答案：A。龙胆泻肝汤

解析：慢性宫颈炎湿热下注型即湿热内蕴证，治法以疏肝清热，利湿止带，方选龙胆泻肝汤加减（A对）。慢性宫颈炎热毒蕴结证首选清热解毒，燥湿止带功效的止带方（B错）合五味消毒饮（D错）。二妙丸（C错）具有燥湿清热功效，用于湿热下注之白带、阴囊湿痒。仙方活命饮（E错）具有清热解毒，消肿散结，活血止痛之功效，主治前庭大腺炎之寒凝痰凝证。